下列哪项结构中牙本质小管方向稍呈水平，使其与牙发育期所形成的原发性牙本质之间常有一明显的分界线
A. 修复性牙本质
B. 透明牙本质
C. 死区
D. 继发性牙本质
E. 前期牙本质

正确答案：D。继发性牙本质

解析：本题考查继发性牙本质。继发性牙本质（D对）中牙本质小管方向稍呈水平，使其与牙发育期所形成的原发性牙本质之间常有一明显的分界线。修复性牙本质也同样有界限，但是其中的牙本质小管排列紊乱且矿化度低。继发性牙本质和修复性牙本质之间交界明显。